女，45岁，G4P2。月经规律，白带增多半年，性交后阴道流血2个月。近3年未体检。妇科检查发现宫颈重度糜烂状，接触性出血（+），子宫附件未见明显异常。宫颈活检组织病理报告为宫颈鳞状细胞癌，浸润深度为7mm。如术后组织病理学证实右侧淋巴结转移，最恰当的处理是
A. 放化疗
B. 观察随访
C. 性激素治疗
D. 物理治疗
E. 生物治疗

正确答案：A。放化疗

解析：中年女性患者，宫颈活检组织病理报告为宫颈鳞状细胞癌，浸润深度为7mm。综合患者的症状、体征和辅助检查，初步诊断为宫颈鳞状细胞癌ⅠB₁期，如术后组织病理学证实右侧淋巴结转移，最恰当的处理是放化疗（A对）。观察随访（B错）适用于治疗后的处理。性激素治疗（C错）、物理治疗（D错）、生物治疗（E错）均不是最恰当的处理。